下列哪项不是伤寒的典型表现
A. 发热
B. 皮疹
C. 腹泻
D. 脾大
E. 表情淡漠

正确答案：C。腹泻

解析：腹泻（C错，为本题正确答案）不是伤寒的典型表现；伤寒的典型临床特征为持续性发热（A对）、表情淡漠（E对）、相对缓脉、皮疹（B对）即玫瑰疹、肝脾肿大（D对）及白细胞减少等。